女，24岁。一周前从外地旅游返家，发热咳嗽呼吸困难，全身酸痛，倦怠，实验室检查：WBC3.2×10⁹/L，血清学检测特异性IgM抗体阳性。患者可能是
A. 衣原体肺炎
B. 病毒性肺炎
C. 真菌性肺炎
D. 细菌性肺炎
E. 传染病

正确答案：B。病毒性肺炎

解析：患者为青年女性，一周前从外地旅游返家，发热咳嗽呼吸困难，全身酸痛，倦怠，WBC3.2×10⁹/L（正常值为4～10×10⁹/L），血清学检测特异性IgM抗体阳性，症状与实验室检查符合病毒性肺炎（B对）的诊断。衣原体肺炎（A错）起病缓慢，临床症状与肺炎支原体相似，表现为咽痛、咳嗽、咳痰、发热等，一般症状较轻。真菌性肺炎（C错）表现为畏寒、高热，咳白色黏痰，痰量多似白泡沫塑料，偶带血丝，随病情进展憋喘、气短加重，尤以夜间为甚。细菌性肺炎（D错）起病急、寒战、高热、呼吸困难、胸痛严重，胸片较典型，但一般血清学检测无特异性抗体。传染病（E错）是一个总的概念，有多种多样的临床表现，最佳选项为病毒性肺炎。